在美国南达州，执业药师应
A. 鼓励公众使用依据药典制成的药物和制剂
B. 保持药房的整洁
C. 保持药房的卫生
D. 配备有足够的可精确测量和称量的器具
E. 是一个良好的公民，并和执法部门互相协作

正确答案：A、B、C、D、E。鼓励公众使用依据药典制成的药物和制剂；保持药房的整洁；保持药房的卫生；配备有足够的可精确测量和称量的器具；是一个良好的公民，并和执法部门互相协作